细菌感染腹泻患者宜选用
A. 小檗碱
B. 阿苯达唑
C. 乳果糖
D. 干酵母
E. 硫糖铝

正确答案：A。小檗碱

解析：本题考查药物的适应证。细菌感染腹泻患者宜选用小檗碱（A对）。感染性腹泻：对痢疾、大肠杆菌感染的轻度急性腹泻应首选小檗碱（黄连素）口服。阿苯达唑（B错）为广谱驱虫药。乳果糖（C错）为渗透性泻药。干酵母（D错）为增进食欲用药。硫糖铝（E错）是黏膜保护药，临床主要用于胃和十二指肠溃疡。